参与合成cDNA的酶是
A. RNA聚合酶
B. 转肽酶
C. 引物酶
D. 逆转录酶
E. DNA聚合酶

正确答案：D。逆转录酶

解析：参与合成cDNA的酶是逆转录酶（D对），其有三种活性：RNA指导的DNA聚合酶活性，DNA指导的DNA聚合酶活性和RNase H活性（水解RNA链）。转肽酶（B错）参与蛋白质的合成。RNA聚合酶（A错）参与的是转录过程，引物酶（C错）和DNA聚合酶（E错）参与DNA的复制。